在病例对照研究中，匹配的主要目的是
A. 提高研究效率，控制混杂因素的作用
B. 保证病例组与对照组有相同的样本量
C. 保证病例组与对照组有-致的研究因素
D. 便于研究对象回忆暴露因素
E. 便于选择对照组

正确答案：A。提高研究效率，控制混杂因素的作用

解析：本题考查匹配的目的。匹配是要求对照在某些特征或因素上与病例保持一致，保证对照与病例具有可比性，以便对两组进行比较时排除匹配因素的干扰。在病例对照研究中，匹配的主要目的是提高研究效率，控制混杂因素的干扰（A对BCDE错）。